家庭常用的洗涤剂主要是
A. 阴阳离子型
B. 阴离子型
C. 阳离子型
D. 高分子型
E. 天然型

正确答案：B。阴离子型

解析：本题考查家庭常用的洗涤剂。洗涤剂是指能够去除物体表面污垢的一类专门配方制品的总称。家庭常用的洗涤剂主要是阴离子型（B对ACDE错）洗涤剂。